男性，52岁。患胃溃疡已12年，近2个月又有复发，下列哪项提示有恶变可能
A. 进行性疼痛，消瘦，贫血
B. 食欲不振
C. 反酸不明显
D. 嗳气
E. 上腹部压痛

正确答案：A。进行性疼痛，消瘦，贫血

解析：早期胃癌70%以上无明显症状，随着病情的发展，可逐渐出现非特异性的、类同于胃炎或胃溃疡的症状，包括上腹部饱胀不适或隐痛、泛酸、嗳气、恶心，偶有呕吐、食欲减退、消化不良、大便潜血阳性或黑便、不明原因的乏力，消瘦或进行性贫血等。所有答案中，进行性疼痛，消瘦，贫血更能提示病情加重，有恶变可能（A对）。